术前判断胰头癌是否侵犯大血管的检查方法是
A. 内镜超声
B. 腹腔血管造影
C. 增强CT
D. B型超声
E. MRCP

正确答案：C。增强CT

解析：术前判断胰头癌是否侵犯大血管的检查方法是增强CT（C对）。CT能较清楚地显示胰腺的形态、肿瘤的位置、肿瘤与邻近血管的关系及后腹膜淋巴结转移情况，结合增强扫描及胰腺三维重建图像，可以清楚地显示胰管和胆管的扩张情况，以及肿瘤是否侵犯门静脉、肠系膜动、静脉等大血管。选择性腹腔血管造影（B错）亦可显示肿瘤与邻近血管的关系，但为有创检查且并发症较多，目前已为CTA及MRA所替代。内镜超声（A错）可发现小于1cm的肿瘤，亦可显示大血管受侵犯程度，但准确性不及增强CT。B型超声（D错）可发现直径2cm以上的胰腺癌；MRCP（磁共振胆胰管造影）（E错）能显示胰、胆管梗阻的部位、扩张程度，但两者均不能判断胰头癌是否侵犯大血管。